中性粒细胞增多见于
A. 伤寒
B. 化脓性感染
C. 病毒感染
D. 再生障碍性贫血
E. 黑热病

正确答案：B。化脓性感染